患者，头发、毛发、皮肤苍白，是因为缺少什么氨基酸
A. 组氨酸
B. 异丙氨酸
C. 色氨酸
D. 酪氨酸
E. 苯丙氨酸

正确答案：D。酪氨酸

解析：苯丙氨酸羟化酶缺陷病人，大量的苯丙酮酸及其部分代谢产物由尿排出，称为苯丙酮尿症（E错）。先天性酪氨酸酶缺乏（D对）的病人，因不能合成黑色素，皮肤毛发等发白，称为白化病。